关于右心房内腔的描述，正确的是
A. 心耳壁较平滑
B. 上腔静脉口有瓣膜
C. 后壁上有卵圆窝
D. 腔静脉窦与心耳之间有界沟分界
E. 有一些心壁小静脉的直接开口

正确答案：E。有一些心壁小静脉的直接开口

解析：有一些心壁小静脉直接开口（E对）于右心房内腔，为心最小静脉的开口，直径小于0.5mm的小孔。